普萘洛尔的药理作用是
A. 增加冠状动脉血流量
B. 降低心肌收缩力
C. 加速心脏传导
D. 降低呼吸道阻力
E. 增加糖原分解

正确答案：B。降低心肌收缩力